男，50岁。车祸2小时急诊入院，经抢救后生命体征平稳，神志清醒。现出现下腹部疼痛，不能排尿4小时。查体：下腹部叩诊呈浊音，直肠指检可触及直肠前方饱满，前列腺尖端浮动感。X线摄片显示骨盆骨折（耻骨下支断裂）。最可能的诊断是
A. 肾损伤
B. 前尿道损伤
C. 输尿道损伤
D. 后尿道损伤
E. 膀胱破裂

正确答案：D。后尿道损伤

解析：男性患者，车祸2小时后出现下腹部疼痛，不能排尿4小时，提示尿道连续性中断。查体：下腹部叩诊呈浊音，直肠指检可触及直肠前方饱满，前列腺尖端浮动感，提示后尿道损伤。X线摄片显示骨盆骨折（耻骨下支断裂）（骨盆骨折病史）。综合该患者的病史、体查、实验室检查，该患者诊断考虑为后尿道损伤（D对）。前尿道损伤（B错）多有会阴部骑跨伤史，且损伤后既出现尿道出血表现；输尿道损伤（C错）多有见于医源性损伤。